医院中哪个设备和场所没有规定必须设置醒目的警示标志
A. 装有放射性废物的设备、容器
B. 放射性废物储存场所
C. 放射诊疗工作场所的入口处
D. 在控制区进出口处
E. 在监督区进出口处

正确答案：E。在监督区进出口处

解析：本题考查警示标志要求。在监督区进出口处（E错，为本题的正确答案）没有规定必须设置醒目的警示标志。医疗机构应当对下列设备和场所设置醒目的警示标志：①装有放射性同位素和放射性废物的设备、容器（A对），设有电离辐射标志；②放射性同位素和放射性废物储存场所（B对），设有电离辐射警告标志及必要的文字说明；③放射诊疗工作场所的入口处（C对），设有电离辐射警告标志；④放射诊疗工作场所应当按照有关标准的要求分为控制区、监督区，在控制区进出口（D对）及其他适当位置，设有电离辐射警告标志和工作指示灯。